供应成熟红细胞能量的主要代谢途径是
A. 糖有氧氧化
B. 糖酵解
C. 2，3-二磷酸甘油酸旁路
D. 糖异生
E. 磷酸戊糖途径

正确答案：B。糖酵解

解析：成熟红细胞没有线粒体，不能进行糖有氧氧化（A错）和糖异生（D错），它进行的糖代谢主要有三种：糖酵解、2，3-二磷酸甘油酸旁路和磷酸戊糖途径。糖酵解（B对）是成熟红细胞获得能量的唯一途径；2，3-二磷酸甘油酸旁路（C错）调节红细胞内血红蛋白的运氧能力；磷酸戊糖途径（E错）生理意义是生成NADPH和磷酸戊糖。